计算2007年某地的婴儿死亡率，分母应为2007年
A. 年初0岁组人口数
B. 年中0岁组人口数
C. 年末0岁组人口数
D. 活产数
E. 平均人口数

正确答案：D。活产数